初孕妇，26岁。妊娠38周。查体：P90次/分，R18次/分，BP120/80mmHg。叩诊心浊音界稍向左扩大，心尖部闻及2/6级收缩期吹风样杂音。踝部轻度水肿。最可能的诊断是
A. 妊娠期高血压疾病性心脏病
B. 风湿性心脏病合并妊娠
C. 心脏病合并妊娠，性质待查
D. 正常妊娠改变
E. 围生期心肌病

正确答案：D。正常妊娠改变

解析：26岁初孕妇，妊娠38周（妊娠晚期指妊娠达到28周以后，该孕妇处于妊娠晚期），呼吸频率18次/分（正常呼吸频率16～20次/分）、心率90次/分（正常心率60～100次/分）、血压120/80mmHg（90mmHg≤正常收缩压≤140mmHg）均正常。心浊音界稍向左扩大（正常妊娠时心脏向左、上、前方移位），心尖部闻及2/6级收缩期吹风样杂音（部分孕妇可闻及心尖区Ⅰ～Ⅱ级柔和吹风样收缩期杂音），踝部轻度水肿（孕妇于妊娠晚期常有踝部、小腿下半部轻度水肿，休息后消退，属生理现象），最可能的诊断是正常妊娠改变（D对）。妊娠期高血压疾病性心脏病（P84）（A错），是指孕妇以往无心脏病病史及体征，在妊娠期高血压疾病的基础上发生以左心衰为主的全心衰竭；风湿性心脏病合并妊娠（P84）（B错）患者孕前会有风湿病病史及心脏瓣膜病变的并发症；心脏病合并妊娠（C错）的患者既往会有心血管疾病病史；围生期心肌病（P84）（E错）是指发生于妊娠晚期至产后6个月内的扩张性心肌病，表现为心肌收缩功能障碍和充血性心力衰竭，四者均为器质性心脏病，听诊心脏多为强度≥3/6级的器质性杂音，且下肢水肿休息后不消退。